后囟一般于生后多久时闭合
A. 2～4周
B. 4～6周
C. 6～8周
D. 8～12周
E. 1～1岁半

正确答案：C。6～8周

解析：后囟：出生时很小或已经闭合，一般于生后6～8周时闭合。掌握“骨骼发育”知识点。